对邻（牙合）嵌体邻面片切洞形的描述哪项是不恰当的
A. 片切面颊舌边缘应达到自洁区
B. 可在片切面内制备箱型固位
C. 用于邻面缺损大而浅时
D. 可在片切面内制备小肩台
E. 用于邻面突度较大时

正确答案：E。用于邻面突度较大时

解析：本题考查邻（牙合）嵌体邻面片切洞形。不可用于邻面突度较大时（E错，为本题的正确答案），因为邻面突度过大不利于制备平直的洞底，强行制备会穿髓，且制备的洞形固位力不足。邻（牙合）嵌体邻面片切洞形片切面颊舌边缘应达到自洁区（A对），以利于自我清洁，防止菌斑滞留，引起龋损。可在片切面内制备箱型固位（B对），制备出底平壁直，点线角圆钝外形，洞壁外敞度2°～5°。用于邻面缺损大而浅时（C对），大而浅的洞形备洞浅，保护牙髓，面积大增加邻（牙合）嵌体固位力。可在片切面内制备小肩台（D对）以增加嵌体固位力。